生物碱为主要有效成分的生药有
A. 天麻
B. 浙贝母
C. 颠茄
D. 马钱子
E. 酸枣仁

正确答案：B、C、D。浙贝母；颠茄；马钱子

解析：本题考查的是生物碱在植物界的分布和存在情况。生物碱为主要有效成分的生药有浙贝母（B对）、颠茄（C对）与马钱子（D对）。生物碱类主要分布于植物界，在动物界中少有发现。生物碱绝大多数存在于双子叶植物中，已知有50多个科的120多个属中存在生物碱。与中药有关的典型的科有毛茛科（黄连属黄连，乌头属乌头、附子）、防己科（汉防己、北豆根）、罂粟科（罂粟、延胡索）、茄科（曼陀罗属洋金花、颠茄属颠茄、莨菪属莨菪）、马钱科（马钱子）、小檗科（三颗针）、豆科（苦参属苦参、槐属苦豆子）等。单子叶植物也有少数科属存在生物碱，如石蒜科、百合科（贝母属的川贝母、浙贝母）、兰科等。少数裸子植物如麻黄科、红豆杉科、三尖杉科和松柏科也存在生物碱。低等植物中仅发现极个别的存在生物碱，如烟碱存在于蕨类植物中，麦角生物碱存在于菌类植物中。地衣、苔藓类植物中仅发现少数简单的吲哚类生物碱。藻类、水生类植物中未发现生物碱。天麻（A错）含酚苷，如其镇静有效成分天麻苷。酸枣仁（E错）含三萜皂苷，如白桦醇和白桦酸等。